最能说明肝硬化病人已存在门脉高压的表现是
A. 腹水
B. 门静脉增宽
C. 脾大
D. 痔核形成
E. 食道静脉曲张

正确答案：E。食道静脉曲张

解析：最能说明肝硬化病人已存在门脉高压的表现是食道静脉曲张（E对）。腹水（A错）是肝功能减退和门脉高压的共同结果，是肝硬化失代偿期最突出的临床表现。门静脉增宽（B错）是门静脉压力升高的间接表现。脾大（C错）是肝硬化门静脉高压较早出现的体征，但不是最有价值的体征。痔核形成（D错）表明侧支循环开放，但较食道静脉曲张少见。